关于补虚药使用原则的叙述，错误的是
A. 身体健康而无虚证者，不宜应用补虚药
B. 湿盛中满者，宜用补气药
C. 湿阻中焦者，慎用补血药
D. 脾虚便溏者，慎用补阴药
E. 阴虚火旺者，不宜应用补阳药

正确答案：B。湿盛中满者，宜用补气药

解析：本题考查的是补虚药的使用注意。湿盛中满者，忌用补气药（B错，为本题正确答案）。补虚药，习称补益药或补养药，是指凡能补充人体物质亏损、增强人体功能活动，以提高抗病能力、消除虚弱证候为主要功效的药物。本类药主要适用于各种虚证，而虚证有气虚、阳虚、血虚、阴虚之别。按其性能功效和临床应用，常将本类药物分为补气药、补阳药、补血药、补阴药四类。其中，补气药功主补气以增强脏腑功能活动，主治气虚诸证。补阳药功主温补人体之阳气，主治阳虚诸证。补血药功主养血，兼能滋阴，主治血虚、阴血亏虚等证。补阴药功主滋阴补液，兼能润燥，主治阴液亏虚诸证。本类药为虚证而设，凡身体健康而无虚证者，不宜应用（A对）；邪实而正气不虚者，不宜乱用补虚药，以防“闭门留寇”；补气药多甘壅滞气，湿盛中满者忌用；补阳药温燥而能伤阴助火，阴虚火旺者不宜应用（E对）；补血与补阴药，大多药性滋腻，易伤脾胃，湿阻中焦及脾虚便溏者慎用（CD对）。使用补虚药，应注意脾胃功能，使补虚药更好的发挥作用。